国家鼓励开展中医药专家学术继承工作，培养高层次的中医临床人才
A. 中药技术人才
B. 中医从业人员
C. 中医医疗机构
D. 中医药教育机构
E. 中医药科研机构

正确答案：A。中药技术人才

解析：《中华人民共和国中医药法》第十六条 国家鼓励开展中医药专家学术经验和技术专长继承工作，培养高层次的中医临床人才和中药技术人才（A对）。